用于支气管哮喘的药物是
A. 去甲肾上腺素，肾上腺素
B. 多巴胺，麻黄碱
C. 异丙肾上腺素，多巴胺
D. 肾上腺素，异丙肾上腺素
E. 苯福林，多巴胺

正确答案：D。肾上腺素，异丙肾上腺素